可以发生于有龋损或者有磨损的牙齿，但未穿髓，炎症常常缓慢刺激牙髓产生的炎症称为
A. 慢性闭锁性牙髓炎
B. 慢性溃疡性牙髓炎
C. 上皮型牙髓息肉
D. 溃疡型牙髓息肉
E. 急性浆液性牙髓炎

正确答案：A。慢性闭锁性牙髓炎

解析：本题考查慢性闭锁性牙髓炎。可以发生于有龋损或者有磨损的牙齿，但未穿髓，炎症常常缓慢刺激牙髓产生的炎症称为慢性闭锁性牙髓炎（A对）。慢性闭锁性牙髓炎发生在有龋损或磨损但未穿髓的情况下，炎症常局限在龋损相对应的牙髓组织。由于尚未穿髓，细菌及其代谢产物经牙本质小管缓慢或低毒地刺激牙髓，使牙髓产生慢性炎症改变。当细菌毒力增强或机体抵抗力下降时，也可转化为急性牙髓炎。